女性，50岁。发热、咳嗽、咳痰3周，近1周来咳大量脓性臭痰，量约300ml/日。体检：T40℃，右下肺叩呈浊音，可闻及湿啰音，杵状指（+）。应考虑的诊断为
A. 支气管炎
B. 慢性肺脓肿
C. 肺炎球菌肺炎
D. 葡萄球菌肺炎
E. 克雷伯杆菌肺炎

正确答案：B。慢性肺脓肿

解析：患者发热、咳嗽、咳痰3周，近1周来咳大量脓性臭痰（为肺脓肿的典型临床表现），量约300ml/日，右下肺叩呈浊音，可闻及湿啰音，杵状指（+），根据其临床表现和体征，考虑诊断为慢性肺脓肿（B对）。支气管炎（P20）（A错）起病缓慢，主要症状为咳嗽、咳痰，无大量脓臭痰。肺炎球菌肺炎（P46）（C错）起病急骤，寒战、高热，全身肌肉酸痛，也无大量脓臭痰。葡萄球菌肺炎（P48）（D错）起病急骤，寒战、高热，但是痰呈脓血状，并不是脓臭痰。克雷伯杆菌肺炎（E错）起病急骤，寒战、高热，但是痰呈特征性的砖红色胶冻状痰，也不是脓臭痰。